患者，男，50岁。右下颌膨隆3个月、下唇麻木2周入院。1年前，患者由于右下后牙松动、疼痛，于当地医院拔除患牙，疼痛缓解；3个月前出现右下颌膨隆，2周前出现右下唇麻木。入院查体：一般情况良好。专科检查：右下颌角及下颌体部稍膨隆，表面皮肤色泽正常。开口度、开口型未见明显异常。口内黏膜未见明显改变，未见溃疡、瘘管、糜烂及新生物。右下第一、二磨牙缺失，右下第一、二前磨牙Ⅰ度松动，咬合关系正常。舌运动良好，无疼痛及麻木感，口底、颊黏膜正常，右下唇麻木。双侧腮腺导管口无红肿，分泌物清亮。双侧面颈部未触及肿大淋巴结。曲面体层片示右下颌自下颌角至右下尖牙可见一大小约7.0cm×2.0cm不规则溶骨性破坏区，边界虫蚀状，波及牙槽骨，自髓质向皮质扩展，密度不均。以下哪种最不符合中央性颌骨癌的X线特征
A. 溶骨性破坏
B. 边缘虫蚀状
C. 骨膜反应
D. 可兼有囊肿及成釉细胞瘤的X线表现
E. 可伴病理性骨折

正确答案：C。骨膜反应

解析：中央性颌骨癌X线早期表现为：病损局限于根尖区骨松质内，呈不规则虫蚀状破坏，以后才破坏并浸润骨密质。需与慢性骨髓炎相鉴别，慢性骨髓炎除骨质破坏外尚有增生修复的表现，如骨膜增生等。掌握“中央性颌骨癌及上颌窦癌”知识点。